下列关于胎盘屏障的说法正确的是
A. 胎盘屏障与一般的毛细血管有明显差别
B. 孕妇体内注射大剂量药物只有很少一部分能够透过胎盘屏障
C. 胎盘屏障能够阻止很多药物进入胎儿体内
D. 胎盘屏障对药物的通透性与血脑屏障无区别
E. 胎盘屏障为胎盘绒毛与子宫血窦之间的屏障

正确答案：E。胎盘屏障为胎盘绒毛与子宫血窦之间的屏障

解析：本题考查药物的吸收和分布。胎盘绒毛与子宫血窦之间的屏障称为胎盘屏障（E对）。胎盘屏障对药物的通透性与一般的毛细血管无明显差别，几乎所有的药物都能穿透胎盘进入胎儿体内。药物进入胎盘后，即在胎儿体内循环，并很快在胎盘和胎儿之间达到平衡。